儿童患夜盲症是由于体内缺乏
A. 钙
B. 铁
C. 视黄醇
D. 核黄素
E. 维生素D

正确答案：C。视黄醇

解析：本题考查儿童常见的营养缺乏性疾病。皮肤和眼部病变是维生素A缺乏的主要表现，夜盲症是眼部病变的表现之一，是由于机体缺乏维生素A即视黄醇（C对ABDE错）而引起。